靶器官为乳腺的药物是
A. 氯米芬
B. 黄体酮
C. 他莫昔芬
D. 米非司酮
E. 雷诺昔芬

正确答案：C。他莫昔芬

解析：本题考查他莫昔芬。靶器官为乳腺的药物是他莫昔芬（C对）。氯米芬（A错）作用于垂体。黄体酮（B错）靶器官为子宫。米非司酮（D错）靶器官为子宫。雷洛昔芬（E错）对雌激素作用的组织有选择性的激动或拮抗作用。